下列有关可摘局部义齿的初戴，对于缺失牙较多的患者说法正确的是
A. 确认咬合接触
B. 确认咬合高度
C. 确认咬合稳定情况
D. 检查排牙是否合适
E. 以上说法均正确

正确答案：E。以上说法均正确

解析：检查排牙是否合适，包括排牙的位置、形状、颜色是否与邻近天然牙协调，对于前牙缺失患者还要确认排牙后的美观效果（中线、位置、大小、形态、丰满度、与唇的关系等）如何，对于缺失牙较多的患者还要确认咬合接触、咬合高度和咬合稳定情况；对于上下颌余留牙无咬合接触的患者还要确认颌位关系、垂直距离和发音是否合适。掌握“局部义齿的初戴”知识点。